下列哪项最符合心力衰竭的概念
A. 心脏每搏输出量降低
B. 静脉回心血量超过心输出量
C. 心输出量不能满足机体的需要
D. 心功能障碍引起大小循环淤血
E. 伴有肺水肿或肝脾肿大下肢水肿的综合征

正确答案：C。心输出量不能满足机体的需要

解析：心力衰竭是指各种原因引起心脏结构功能改变，导致心脏泵功能（心脏主要的功能）减退，心脏每搏输出量降低，心输出量不能满足机体的需要，并引起肺循环或体循环静脉淤血，可表现为肺水肿或肝脾肿大、下肢水肿。心衰时心脏泵功能衰退，泵功能即推动血液循环到达全身以满足机体代谢需要，因而最符合心力衰竭的概念是心输出量不能满足机体的需要（C对）。